经络按诊最常用的部位是
A. 交会穴
B. 五输穴
C. 背俞穴
D. 八会穴
E. 八脉交会穴

正确答案：C。背俞穴

解析：经络按诊是指在经络腧穴部位上运用按压、触摸等方法来寻找异常变化，如压痛、硬结、条索状物、肿胀、凹陷等，并借以诊断疾病的方法。经络按诊最常用的部位是背俞穴（C对），如肺俞穴摸到结节为肺病的表现，胃俞穴有压痛，多提示胃病，其次是胸腹部的募穴以及四肢的原穴、郄穴、合穴或阿是穴。